在下列医学伦理学任务的提法中，错误的是
A. 为医学的发展导向
B. 反应社会对医学的需求
C. 为符合医学道德的行为辩护
D. 制定与预防诊断治疗相对应的伦理准则
E. 在医患关系中，只是竭力维护患者的权益

正确答案：E。在医患关系中，只是竭力维护患者的权益

解析：医学伦理学的任务有：①为医学的发展导向（A对）确定符合时代要求的医德和规范；②反映社会对医学的需求（B对）；③为符合道德医学的行为辩护（C对）；④制定与预防诊断治疗相对应的伦理准则（D对）。医务人员尊重病人的伦理原则，其实现取决于医务人员对其合理性的认同以及医患之间平等关系的认可和构建，并不是在医患关系中，只是竭力维护患者的权益（E错，为本题正确答案）。